99mTc核素显像呈“热”结节特征的是
A. 混合瘤
B. 沃辛瘤
C. 腺样囊性癌
D. 腺泡细胞癌
E. 黏液表皮样瘤

正确答案：B。沃辛瘤

解析：本题考查沃辛瘤的临床特点。99mTc核素显像呈“热”结节特征的是沃辛瘤（B对），沃辛瘤（Warthin tumor）（B对）又名腺淋巴瘤（adenolymphoma)或乳头状淋巴囊腺瘤。沃辛瘤具有以下临床特点：①多见于男性，男女比例约为6：1；②好发于年龄在40～70岁的中老年；③患者常有吸烟史，其发病可能与吸烟有关；④可有消长史；⑤绝大多数肿瘤位于腮腺后下极；⑥扪诊肿瘤呈圆形或卵圆形，表面光滑，质地较软，有时有弹性感；⑦肿瘤常呈多发性；⑧术中可见肿瘤呈紫褐色，剖面可见囊腔形成，内含干酪样或黏稠液体,易被误诊为结核或囊肿；⑨Tc核素显像星“热"结节，具有特征性。混合瘤（多形性腺瘤）（A错）、腺样囊性癌（C错）、腺泡细胞癌（D错）、黏液表皮样瘤（E错）都不具备99mTc核素显像呈“热”结节特征。